浸润黏膜固有层的膀胱肿瘤的分期是
A. Ta
B. T1
C. T2
D. T3
E. T4

正确答案：B。T1